根据国家关于药品出口管理的有关规定，知悉自身药品生产场地不符合《药品生产质量管理规范》要求，药品生产企业未立即报告的，药品监督管理部门应当注销该企业药品出口销售证明，并在一段时间内不再为该企业出具药品出口销售证明，该段时间不得少于
A. 5年
B. 3年
C. 1年
D. 2年

正确答案：A。5年

解析：本题考查药品出口销售证明管理。根据国家药品出口管理的有关规定，知悉自身药品生产场地不符合《药品生产质量管理规范》要求，药品生产企业未立即报告的，药品监督管理部门应当注销该企业药品出口销售证明，并在一段时间内不再为该企业出具药品出口销售证明，该段时间不得少于5年（A对）。提供虚假证明或者采用其他手段骗取药品出口销售证明的，或知悉生产场地不符合药品GMP要求未立即报告的，注销其药品出口销售证明，且5年内不再为其出具药品出口销售证明，并将企业名称、法定代表人、社会信用代码等信息通报征信机构进行联合惩戒。药品出口销售证明有效期不超过2年（D错），且不应超过申请资料中所有证明文件的有效期，有效期届满前应当重新申请。